五脏的生理功能特点是
A. 传化物而不藏，实而不满也
B. 藏精气而不泻，实而不能满
C. 传化物而不藏，满而不能实
D. 藏精气而不泻，满而不能实
E. 虚实交替，泻而不藏

正确答案：D。藏精气而不泻，满而不能实

解析：五脏内部组织相对充实，共同生理功能是化生和贮藏精气，所以五脏的生理功能特点是藏精气而不泻，满而不能实，所谓“满而不实”是强调五脏精气宜充满（D对）。六腑多呈中空的囊状或管腔形态，共同生理功能是受盛和传化水谷，故其生理功能特点是传化物而不藏，实而不能满，所谓“实而不满”是指六腑水谷宜充实而虚实更替。